男，52岁，从高处摔落，右胸痛25分钟，心率102bpm，呼吸22次/分，血压110/70mmHg，右侧胸廓完全塌陷，肺压缩10%，神志清楚，双肺未闻及干湿啰音，最有效的治疗措施是
A. 胸腔抽刺排气
B. 胸腔闭式引流
C. 建立有效的呼吸
D. 静脉补液
E. 镇静、止痛

正确答案：E。镇静、止痛

解析：该患者男，52岁，从高处摔落，出现右胸痛，心率102bpm，呼吸22次/分，血压110/70mmHg，右侧胸廓完全塌陷，肺压缩10%，神志清楚，双肺未闻及干湿啰音，结合患者的病史，表现和查体，诊断为肋骨骨折，镇静、止痛是最有效的治疗措施（E对）。休克治疗需要建立有效的呼吸、镇静补液不属于肋骨骨折最有效的治疗措施（CD错）。